关于抗菌药物全身应用哪项是正确的
A. 抗菌药物可杀灭牙周袋壁组织内的微生物，故应长期使用
B. 抗菌药物作用可达深牙周袋底及根分叉等局部处理难以达到的区域，故可常规应用于牙周炎
C. 为了使牙周袋内药物浓度更高，牙周炎时使用药物必须超剂量
D. 为了提高治疗效果，应将杀菌剂如青霉素与抑菌剂如四环素同时应用
E. 抗生素不应常规应用于牙周炎

正确答案：E。抗生素不应常规应用于牙周炎

解析：本题考查抗菌药物的全身应用。抗菌药可以作为牙周系统治疗计划中必要的补充，而不应常规应用于牙周炎，因为单纯的洁治术和根面平整术也能达到良好的治疗效果（E对B错）。大剂量、长时间的全身使用抗菌药物，易引起菌群失调，造成叠加感染（AC错）。抗菌药物可以联合应用，但是应避免药物之间的拮抗作用，例如杀菌剂如青霉素与抑菌剂如四环素同时应用会产生拮抗作用（D错）。